男性，2岁。因突发阵发性腹痛，哭闹，伴呕吐和果酱样血便6小时来诊。查体：腹肌软，脐右下方扪及肿块，有压痛，右下腹扪诊有空虚感。首选检查方法是
A. 腹部B超
B. 空气或钡剂灌肠
C. 腹部CT
D. 腹部磁共振
E. 腹腔穿刺

正确答案：B。空气或钡剂灌肠

解析：2岁男童，突发阵发性腹痛，伴呕吐和果酱样血便，脐右下方扪及肿块，有压痛，右下腹扪诊有空虚感，应诊断为肠套叠。为明确诊断，首选的检查是空气或钡剂灌肠（B对）。肠套叠的空气或钡剂灌肠X线检查表现为空气或钡剂在结肠受阻，阻端呈“杯口”状，甚至呈现“弹簧状”阴影。同时空气或钡剂灌肠还可用于治疗早期肠套叠。腹部B超（A错）、腹部CT（C错）、腹部磁共振（D错）对腹部空腔脏器的显示效果不佳，一般不用于肠套叠的诊断。肠套叠时腹腔穿刺多为阴性，故对其诊断价值不大（E错）。